肩关节是人体内活动范围最大、运动最灵活的关节，可作前屈、后伸、内收、外展、旋内、旋外和环转运动。运动肩关节的肌较多，既包括背肌、胸上肢肌，又包括肩肌和臂肌。有些肌的作用比较简单，而有些肌的作用则较复杂。可使肩关节旋外的肌是
A. 三角肌和胸大肌
B. 冈上肌和冈下肌
C. 三角肌和冈下肌
D. 胸大肌和小圆肌
E. 大圆肌和肩胛下肌

正确答案：C。三角肌和冈下肌

解析：三角肌后部肌群能使肩关节伸、旋外，冈下肌收缩使肩关节旋外（C对）。冈上肌作用是使肩关节外展（B错）。胸大肌收缩使肩关节内收和旋内，锁骨部肌束还可使肩关节前屈（A错）；小圆肌收缩时使肩关节旋外（D错）。大圆肌收缩使肩关节后伸、内收和旋内；肩胛下肌收缩时使肩关节内收和旋内（E错）。